某男，患鼓胀。医师处方中有京大戟、芫花，内服宜选用的炮制品是
A. 酒炙品
B. 醋炙品
C. 蜜炙品
D. 盐炙品
E. 姜炙品

正确答案：B。醋炙品

解析：本题考查的是现行《中国药典》收载毒性药材和饮片的用法用量。医师处方中有京大戟、芫花，内服宜选用的炮制品是醋炙品（B对）。芫花有毒，用量1.5～3g。醋芫花研末吞服，每日每次0.6～0.9g。京大戟有毒，用量1.5～3g。入丸散服，每次1g；内服醋制用。